根据《疫苗流通和预防接种管理条例》，可以向接种单位、其他疫苗批发企业销售第二类疫苗的是
A. 定点药品零售企业
B. 疫苗药品批发企业
C. 县级疾病预防控制机构
D. 设区的市级以上疾病预防控制机构
E. 国家疾病预防控制机构

正确答案：B。疫苗药品批发企业